肘横纹中，肱二头肌肌腱桡侧凹陷中的腧穴是
A. 尺泽
B. 曲泽
C. 少海
D. 小海
E. 曲池

正确答案：A。尺泽

解析：位于肘横纹中，肱二头肌肌腱桡侧凹陷中的腧穴是尺泽(A对)。曲泽位于肘前区，肘横纹上，肱二头肌腱的尺侧缘凹陷中（B错）。少海位于肘前区，横平肘横纹，肱骨内上髁前缘（C错）。小海位于肘后区，尺骨鹰嘴与肱骨内上髁之间凹陷中（D错）。曲池位于肘区，在尺泽与肱骨外上髁连线中点凹陷处（E错）。